某男，55岁，有糖尿病史，口渴引饮，能食与便溏并见，精神不振，四肢乏力；舌质淡，苔薄白，脉细弱。根据临床表现，该患者的中医辨证是
A. 胃火炽盛
B. 肾阴亏虚
C. 阴阳两盛
D. 脾胃气虚
E. 肝火上扰

正确答案：D。脾胃气虚

解析：本题考查的是消渴的辨证论治。有糖尿病史，口渴引饮，能食与便溏并见，精神不振，四肢乏力；舌质淡，苔薄白，脉细弱。根据临床表现，该患者的中医辨证是脾胃气虚（D对）。消渴是以多饮、多食、多尿、乏力、消瘦，或尿有甜味为主要临床表现的疾病。其中以口渴多饮为主者称为“上消”；消谷善饥为主者称为“中消”；小溲多而频，或浑浊为特点的称为“下消”。三者也可并见。西医学的糖尿病、尿崩症和精神性多饮、多尿症等以上述临床表现为主者，均可参考此内容辨证论治。（一）阴虚燥热证：【症状】烦渴引饮，消谷善饥，小便频数而多，尿浑而黄，形体消瘦，舌红，苔薄黄，脉滑数。（二）脾胃气虚证：【症状】口渴引饮，能食与便溏并见，或饮食减少，精神不振，四肢乏力。舌淡，苔薄白而干，脉细弱无力。（三）气阴两虚证：【症状】口渴引饮，能食与便溏并见，或饮食减少，精神不振，四肢乏力，体瘦。舌质淡红，苔白而干，脉弱。（四）肾阴亏虚证（B错）：【症状】尿频量多，浊如膏脂，腰酸膝软，头晕耳鸣，多梦遗精，乏力，皮肤干燥。舌红少苔，脉细数。（五）阴阳两虚证：【症状】小便频数，甚则饮一溲一，咽干舌燥，面容憔悴，耳轮干枯，腰膝酸软，畏寒肢冷。舌淡，苔白少津，脉沉细无力。肝火上扰（E错）为耳鸣耳聋的辨证。耳鸣耳聋肝火上扰证：【症状】耳鸣或耳聋突然发生，如闻潮声，或如雷鸣，时轻时重，多随情绪而波动，伴有头痛眩晕，面赤目赤，口苦咽干，烦躁，或夜寐不安，大便秘结。舌质红，苔黄，脉弦数。辨证为胃火炽盛（A错）或阴阳两盛（B错）的病证，2022年考试指南未明确说明。